双侧支气管扩张患者反复大咯血时，最佳的治疗手段是
A. 长期使用抗生素
B. 支气管动脉栓塞术
C. 手术切除病变肺叶
D. 口服钙通道阻滞剂
E. 支气管镜下介入治疗

正确答案：B。支气管动脉栓塞术

解析：双侧支气管扩张反复大咯血，考虑广泛性病变采用支气管动脉栓塞术治疗（B对）。支扩出现痰量及其脓性成分增加等急性感染征象时需应用抗生素（A错）。切除病变肺叶（C错）适用于病变局限的支气管扩张反复大咯血。口服钙通道阻滞剂（D错）适用于变异性心绞痛以及降压的治疗，与治疗支扩导致的大咯血无关。支气管镜下介入治疗（E错）不适合双侧支扩的大咯血。